24岁女性，停经58天，13天前行人工流产吸宫术。术后持续阴道流血。确诊后首选的治疗措施是
A. 应用抗生素
B. 抗生素+宫缩剂
C. 抗生素+止血剂
D. 抗生素+清宫术
E. 宫缩剂+清宫术

正确答案：D。抗生素+清宫术

解析：患者为青年女性，停经后行人工流产吸宫术，术后持续阴道流血（手术后阴道流血时间长，血量多或流血停止后再现多量流血，应考虑为吸宫不全），初步考虑的诊断是吸宫不全。确诊后首选的治疗措施是抗生素+清宫术（D对）。清宫术后应将刮出物送病理检查，术后给予抗生素预防感染。若同时伴有感染，应控制感染后再行刮宫术。